肝裸区为
A. 肝镰状韧带两层间的区域
B. 肝三角韧带两层间的区域
C. 肝冠状韧带两层间的区域
D. 肝胃韧带两层间的区域
E. 肝圆韧带两层间的区域

正确答案：C。肝冠状韧带两层间的区域

解析：肝裸区为肝的肝冠状韧带两层间的区域(C对)。